以下有关“总大肠菌群”论述，哪项是错误的
A. 在人体肠道内，大肠菌群的数量最多
B. 在外环境中的生存条件与肠道致病菌相似
C. 是肠道传染病的主要病原体
D. 是反映水体受类便污染的一项重要指标
E. 生活饮用水卫生最新标准中规定不得检出

正确答案：C。是肠道传染病的主要病原体

解析：本题考查总大肠菌群的相关内容。总大肠菌群是指一群需氧及兼性厌氧的在37℃生长时能使乳糖发酵、在24小时内产酸产气的革兰阴性无芽孢杆菌。总大肠菌群是肠道内的大肠属菌群，是肠道正常菌群的主要成分（C错，为本题正确答案），它们在肠道内的数量最多（A对），在外环境中的生存条件与肠道致病菌相似（B对），是反映水体受粪便污染的一项重要指标（D对）。生活饮用水卫生最新标准中规定不得检出总大肠菌群（E对）。